患者，男，43岁。左大腿内侧发现肿物10年，不疼痛，活动正常。检查:局部皮下可及1个15cm×10cm×5cm大小的肿物，质地软，表面光滑，无压痛及缩小，推之可移。应首选的治疗措施是
A. 内治法
B. 外治法
C. 手术法
D. 针刺法
E. 神灯照

正确答案：C。手术法

解析：该患者左大腿内侧发现肿物，不疼痛，质地软，表面光滑，无压痛及缩小，推之可移，故诊断为肉瘤。血瘤压之可缩小，皮色鲜红或色紫，筋瘤发于下肢，青筋如蚯蚓聚结。内治法可用于较小瘤体的治疗或较大瘤体切除后的配合治疗（A错）。外治法不适宜较大瘤体（B错）。肉瘤瘤体较大者，宜行手术切除（C对）。针刺法常用于治疗瘰疬，瘾疹，蛇串疮等，不适宜较大瘤体（D错）。神灯照功能活血消肿，解毒止痛，适用于痈疽轻证（E错）。